根据《药品经营质量管理规范》，关于药品储存与养护要求的说法，正确的是
A. 中药材与中药饮片必须分库存放
B. 不同批号的药品必须分库存放
C. 药品与非药品必须分库存放
D. 外用药与其他药品必须分库存放

正确答案：C。药品与非药品必须分库存放

解析：本题考查药品储存与养护。药品储存要求：药品与非药品、外用药与其他药品分开存放（C对），中药材和中药饮片分库存放。